不属于糖皮质激素的是
A. 倍氯米松
B. 布地奈德
C. 泼尼松
D. 保泰松
E. 地塞米松

正确答案：D。保泰松

解析：本题考查糖皮质激素。不属于糖皮质激素的是保泰松（D错，为本题正确答案）。保泰松为非甾体类抗炎药。常用的糖皮质激素类药物有倍氯米松（A对）、布地奈德（B对）、泼尼松（C对）、地塞米松（E对）、曲安奈德、氟替卡松、糠酸莫米松等。